肠系膜下淋巴结
A. 其输出淋巴管形成颈干
B. 收纳左颈部淋巴
C. 收纳降结肠至直肠上段的淋巴
D. 其输出淋巴管即肠干
E. 其输出淋巴管注入左腰干

正确答案：D。其输出淋巴管即肠干

解析：肠系膜下淋巴结、肠系膜上淋巴结和腹腔淋巴结合成肠干（D对）。